心外膜的构成成分是
A. 纤维性心包
B. 纵隔胸膜
C. 深筋膜
D. 浆膜性心包脏层
E. 浆膜性心包壁层

正确答案：D。浆膜性心包脏层

解析：浆膜性心包的脏层（D对）包于心肌的表面，构成心外膜，其内有少量浆液起润滑作用。